下列对医生义务描述错误的是
A. 诊断治疗义务
B. 恢复患者健康义务
C. 解析说明义务
D. 善于保密义务
E. 减轻病人痛苦的义务

正确答案：B。恢复患者健康义务